病例对照研究使用分级资料分析的目的是
A. 控制混杂因素
B. 提高研究效率
C. 检验交互作用
D. 检验剂量反应关系
E. 缩小OR值的95%CI

正确答案：D。检验剂量反应关系

解析：本题考查病例对照研究使用分级资料分析的目的。在进行病例对照研究中，当获得的某些暴露因素为不同暴露水平时，该资料为分级资料，需要进行资料的分级分析。分级分析是将不同水平的暴露分别与无暴露或最低水平的暴露作比较，可以分析暴露与疾病之间是否存在剂量-反应关系（D对ABCE错）。